小陷胸汤的主治证候有
A. 痰白而稀
B. 干咳无痰
C. 咳痰黄稠
D. 痰中带血
E. 咳嗽痰多

正确答案：C。咳痰黄稠

解析：小陷胸汤功效为清热化痰，宽胸散结，主治心下痞满，按之则痛，或心胸闷痛，咳痰黄稠（C对）的小陷胸证，为治疗痰热互结之小陷胸证之基础方。